男，23岁，急性脑膜炎入院急诊治疗，使用青霉素有效的依据是
A. 青霉素为脂溶性药物
B. 青霉素为水溶性药物
C. 血脑屏障能够阻碍水溶性药物通过
D. 血脑屏障能够阻碍脂溶性药物通过
E. 脑膜炎使血脑屏障通透性增加

正确答案：E。脑膜炎使血脑屏障通透性增加

解析：血脑屏障在正常时能够阻碍许多大分子、水溶性或解离性药物通过，但脑膜炎患者的血脑屏障对青霉素通透性增加，使青霉素在脑脊液中达到有效的治疗浓度。掌握“药物的吸收和分布”知识点。